职业卫生标准是
A. 管理生产的条例
B. 降低生产成本的依据
C. 保障工人在安全卫生条件下劳动的行政管理依据
D. 安全劳动的规范
E. 以上都不是

正确答案：C。保障工人在安全卫生条件下劳动的行政管理依据